可摘局部义齿固位体必须具备的条件不包括
A. 有固位作用
B. 对基牙不产生侧向力
C. 必须选用同种类型的卡环
D. 显露金属要少
E. 不损伤口内的软硬组织

正确答案：C。必须选用同种类型的卡环

解析：固位体必须具备的条件：①有固位作用，能保证义齿不致脱位。②对基牙不应产生矫治性移位。③取戴义齿时，对基牙应无侧方压力，不损伤基牙。④显露金属要少，不影响美观。⑤不损伤口内的软硬组织。⑥不易存积食物，以免造成余留牙龋坏和牙周炎症。⑦固位体的颊、舌臂和各固位体间，尽量有交互对抗作用。⑧应尽量避免在口内使用不同种类的金属，以免产生电流作用。掌握“局部义齿的设计”知识点。